肾综合征出血热属于
A. 蚊传性出血热
B. 蜱传性出血热
C. 动物源性出血热伴肾综合征
D. 动物源性出血热不伴肾综合征
E. 传播途径不明的出血热

正确答案：C。动物源性出血热伴肾综合征